下列实行终止妊娠或者结扎手术的程序说法错误的是
A. 经本人同意
B. 需要收取费用
C. 签署意见
D. 本人无行为能力的，应当经其监护人同意
E. 依照《母婴保健法》规定施行

正确答案：B。需要收取费用

解析：实行终止妊娠或者结扎手术的程序　依照《母婴保健法》规定施行终止妊娠或者结扎手术，应当经本人同意，并签署意见；本人无行为能力的，应当经其监护人同意，并签署意见。依法施行终止妊娠或者结扎手术的，接受免费服务。掌握“母婴保健法及其实施办法”知识点。